呼吸性酸中毒中，哪一项指标的变化是正确的
A. AB降低
B. PaC02升高
C. SB降低
D. BB降低
E. BE降低

正确答案：B。PaC02升高

解析：呼吸性酸中毒时，PaC02升高（B对）导致pH降低，通过肾等代偿后，代谢性指标继发性升高，AB（A错）、SB（C错）、BB（D错）值均升高，AB>SB,BE（E错）正值加大。